男，70岁，发现大量蛋白尿2周入院。入院后查本周蛋白尿阳性。为明确诊断，检查意义最大的是
A. 肾活检
B. 骨髓穿刺
C. 核素骨扫描
D. 全身X线骨摄片
E. 血清蛋白电泳

正确答案：B。骨髓穿刺

解析：患者老年男性（多发性骨髓瘤好发于老年人），发现大量蛋白尿2周入院，查本周蛋白尿阳性（90%多发性骨髓瘤患者有蛋白尿，半数患者本周蛋白尿阳性，有重要诊断价值），提示多发性骨髓瘤，为明确诊断应给予骨髓穿刺（B对）检查，找到大量的异常浆细胞即可确诊多发性骨髓瘤。肾活检（P459）（A错）主要用于明确各种原发性肾小球疾病的组织病理学诊断；核素骨扫描（C错）主要用于恶性肿瘤骨转移的诊断；全身X线骨摄片（P593）（D错）可发现溶骨性破坏、骨质疏松，有助于诊断，但不具有特异性；血清蛋白电泳（九版诊断学P354）（E错）可检测出血清蛋白异常，对于肝脏疾病、多发性骨髓瘤、巨球蛋白血症、结缔组织病等具有提示意义，但不具有特异性，确诊价值不大。